女，31岁。发热伴刺激性干咳3天，一周前陪伴5岁女儿住院，女儿4天前好转已出院，查体：T38.5℃，心肺正常，血常规正常，胸部X线片示右下肺少许簿片状阴影，该患者经验性治疗首选的药物是
A. 阿莫西林
B. 阿奇霉素
C. 头孢呋辛
D. 奥司他韦
E. 阿米卡星

正确答案：B。阿奇霉素

解析：患者青年女性，一周前陪伴5岁女儿住院，女儿4天前好转已出院（支原体感染多见于儿童及青少年，多有数天至一周潜伏期），出现发热伴刺激性干咳3天（支原体感染常见症状），查体：T38.5℃（正常腋温36～37℃，提示中热），心肺正常，血常规正常，胸部X线片示右下肺少许簿片状阴影。综合患者病因，症状及影像学检查，考虑诊断为支原体感染，首选治疗为大环内酯类，如阿奇霉素（B对）。阿莫西林（A错）为青霉素类抗菌药物，多用于大叶性肺炎的治疗。头孢呋辛（C错）为二代头孢菌素，主要用于治疗金黄色葡萄球菌肺炎。奥司他韦（D错）为神经氨酸酶抑制剂，主要用于治疗病毒性肺炎。阿米卡星（E错）为氨基糖苷类抗生素，主要用于克雷伯杆菌肺炎、铜绿假单胞菌肺炎。